不宜选择葡萄糖注射液作为溶剂的药物是
A. 青霉素
B. 红霉素
C. 磷霉素
D. 环丙沙星
E. 甲硝唑

正确答案：A。青霉素

解析：本题考查药物的适宜溶剂。青霉素（A对）含β-内酰胺环，极易裂解而失效，酸性较强的葡萄糖注射液可促进青霉素裂解。红霉素（B错）、磷霉素（C错）、环丙沙星（D错）、甲硝唑（E错）均可选用葡萄糖注射液溶解。